室间隔膜部分隔
A. 左心室与右心室
B. 右心室与左心房
C. 右心室与左心室、左心房
D. 左心房与左心室、右心房
E. 左心室与右心室、右心房

正确答案：E。左心室与右心室、右心房

解析：左心室与右心室、右心房（E对）均被室间隔膜部所分隔，其中膜部后上部位于右心房与左心室之间称房室部，而膜部前下部位于左、右心室之间称室间部。